白血病可见
A. 皮下气肿
B. 胸骨压痛
C. 吸气时肋间隙回缩
D. 上腔静脉阻塞
E. 肋间隙膨隆

正确答案：B。胸骨压痛

解析：胸骨压痛或叩击痛可见于骨髓异常增生以及白血病患者（B对）。胸部皮下气肿多由肺、气管、胸膜受损或病变所致，偶见于产气杆菌感染或气胸穿刺引流时（A错）。吸气时肋间隙回缩提示呼吸道阻塞，胸膜增厚粘连胸膜增厚粘连可见吸气时肋间隙回缩（C错）。上腔静脉阻塞时出现胸壁静脉曲张（D错）。中至大量积液时，患侧胸廓饱满，触觉语颤减弱，局部叩诊浊音，呼吸音减低或消失。可伴有气管、纵隔向健侧移位（E错）。